颈干
A. 注入胸导管
B. 注入右淋巴导管
C. 由颈外侧深淋巴结输出管合成
D. 由颈外侧浅淋巴结输出管合成
E. 左颈干注入胸导管

正确答案：E。左颈干注入胸导管

解析：颈干按位置分为两条，分别是左颈干和右颈干，右颈干注入右淋巴导管（B错），左颈干注入胸导管（E对）。